右上6远中邻面龋坏所制备的窝洞类型是
A. Ⅰ类洞
B. Ⅱ类洞
C. Ⅲ类洞
D. Ⅳ类洞
E. V类洞按G.V.Black分类法

正确答案：B。Ⅱ类洞

解析：本题考查银汞充填窝洞的概念。Ⅱ类洞（B对）：为发生于后牙邻面的龋损所制备的窝洞，称为Ⅱ类洞。包括磨牙和前磨牙的邻面洞、邻（牙合）面洞和邻颊（舌）面洞，以磨牙邻（牙合）面洞为典型代表。